女，60岁。咳嗽伴痰中带血3个月，胸部X线片示左肺门阴影，大小3cm×2cm，行痰细胞学检查3次均为阴性，对明确诊断有价值的检查
A. 支气管镜检查
B. 经胸壁穿刺活检
C. 胸部MRI
D. 胸部CT
E. 再次痰液检查癌细胞

正确答案：A。支气管镜检查

解析：老年女性患者，咳嗽伴痰中带血（提示可能为肺部肿瘤），胸部X线片示左肺门3cm×2cm阴影（提示肿瘤可能位于肺门部位），结合患者病史、临床表现和影像学检查，该患者最可能的诊断为左侧肺癌。由于肿块靠近肺门，因此对确诊最有价值的检查为支气管镜检查（A对），其可在直视下钳取病变部位组织标本，进行病理学诊断（肺癌诊断的金标准）。经胸壁穿刺活检（B错）主要用于周围型肺癌的诊断。胸部MRI（C错）、胸部CT（D错）均为影像学检查方法，可作为肺癌的辅助诊断方法，但不能确诊肺癌。患者已行3次痰细胞学检查，再次痰液检查癌细胞（E错）意义不大。